耻骨联合
A. 韧带连结
B. 软骨连结
C. 骨性连合
D. 间接连结
E. 无

正确答案：B。软骨连结

解析：耻骨联合是由耻骨上、下支相互移行处内侧两侧耻骨联合面借纤维软骨（B对）相接。